动脉血压在多大范围内变动时，肾小球毛细血管压和肾血流量保持相对恒定
A. 5.3～13.3kPa（40～100mmHg）
B. 6.7～18.6kPa（50～140mmHg）
C. 8.0～16.0kPa（60～120mmHg）
D. 10.7～24.0kPa（80～180mmHg）
E. 24.0～29.3kPa（180～220mmHg）

正确答案：D。10.7～24.0kPa（80～180mmHg）